采猎二、三级保护野生药材物种的，必须首先取得
A. 合格证
B. 许可证
C. 采伐证
D. 狩猎证
E. 采药证

正确答案：E。采药证

解析：本题考查国家重点保护野生药材采猎管理。采猎二、三级保护野生药材物种的，必须首先取得采药证（E对）。《野生药材资源保护管理条例》规定，禁止采猎一级保护野生药材物种。采猎、收购二、三级保护野生药材物种必须按照批准的计划执行。采猎者必须持有采药证，需要进行采伐或狩猎的，必须申请采伐证（C错）或狩猎证（D错）。不得在禁止采猎期、禁止采猎区采猎二、三级保护野生药材物种，并不得使用禁用工具进行采猎。二、三级保护野生药材物种属于国家计划管理的品种，由中国药材公司统一经营管理，其余品种由产地县药材公司或其他单位按照计划收购。